以行血调气治疗痢疾的主方是
A. 白头翁汤
B. 连理汤
C. 芍药汤
D. 胃苓汤
E. 葛根芩连汤

正确答案：C。芍药汤

解析：芍药汤方含芍药、当归，以养血和血；槟榔、木香，以行气；黄连、黄芩，以清热解毒燥湿；共奏调气和血（C对），清热解毒之功。并配以大黄，泻下通腑，导湿热从大便而去；少量温热之肉桂，制芩、连之苦寒。主治湿热痢疾。